下面哪项描述不是球菌性口炎的临床表现
A. 口腔黏膜充血，局部形成糜烂或溃疡
B. 溃疡或糜烂的表面上覆盖假膜
C. 口腔黏膜出现白色网纹样病变
D. 患者唾液增多，疼痛明显
E. 区域淋巴结肿大压痛

正确答案：C。口腔黏膜出现白色网纹样病变

解析：本病可发生于口腔黏膜任何部位，口腔黏膜充血，局部形成糜烂或溃疡。在溃疡或糜烂的表面覆盖着一层灰白色或黄褐色假膜，假膜特点是较厚微突出黏膜表面，致密而光滑。擦去假膜，可见溢血的糜烂面。周围黏膜充血水肿。患者唾液增多，疼痛明显，有炎性口臭。区域淋巴结肿大压痛。有些患者可伴有发热等全身症状。涂片及细菌培养可明确诊断。血象检查白细胞数增高。掌握“球菌性口炎”知识点。